脾肾亏虚表现是
A. 横目斜视
B. 昏睡露睛
C. 瞳孔散大
D. 目睛微定
E. 双睑下垂

正确答案：E。双睑下垂

解析：双眼上睑下垂者，多为先天禀赋不足，脾肾亏虚，睑肌失养所致（E对）。固定侧视者，称横目斜视，多属肝风内动之征（A错）。昏睡露睛是指患者入睡后胞睑未闭合而睛珠外露。多因脾虚清阳不升，或津液大伤，胞睑失养，启闭失常所致，多见于脾胃虚衰或吐泻伤津的患者（B错）。瞳孔散大多属肾精耗竭，见于危重患者，是濒死前的征象之一，也见于肝胆风火上扰的绿风内障、中毒（如杏仁、麻黄、曼陀罗中毒）及某些西药（如阿托品）所致的药物性瞳孔散大等（C错）。脾肾亏虚不会出现目睛微定（D错）。